治疗出血，血瘀经闭，风湿痹痛，应选用的药物是
A. 生地黄
B. 侧柏叶
C. 茜草
D. 地榆
E. 槐花

正确答案：C。茜草

解析：茜草的功效为凉血，祛瘀，止血，通经。治疗吐血，衄血，崩漏，外伤出血；瘀阻经闭，风湿痹痛，跌扑肿痛。茜草味苦性寒，善走血分，既能凉血止血，又能化瘀止血；茜草主入肝经，能活血通经，故可治疗血滞闭经、风湿痹痛（C对）。生地黄的功效为清热凉血，养阴生津。治疗热入营血，温毒发斑；血热出血；热病伤阴，舌绛烦渴，内热消渴；阴虚发热，骨蒸劳热；津伤便秘（A错）。侧柏叶的功效为凉血止血，化痰止咳，生发乌发。治疗吐血，衄血，咳血，便血，崩漏下血；肺热咳嗽，咯痰黄稠；血热脱发，须发早白（B错）。地榆的功效为凉血止血，解毒敛疮。治疗血热便血，痔血，血痢，崩漏；水火烫伤，痈肿疮毒，湿疹（E错）。